在某些年轻患者抵抗力强、感染轻微的情况下，肉芽肿可呈修复性反应，形成
A. 慢性根尖周肉芽肿
B. 急性牙槽脓肿
C. 急性牙周脓肿
D. 根尖周囊肿
E. 致密性骨炎

正确答案：E。致密性骨炎

解析：本题考查急慢性根尖周炎。某些年轻患者在抵抗力很强、感染轻微的低度刺激作用下，肉芽肿可呈现修复性反应，炎症减轻，吸收处骨质重新沉积，骨小梁增生，骨髓腔缩小，骨髓被纤维组织取代。此又称为致密性骨炎（E对）。